百合固金汤的主治证候中常见
A. 咳痰带血
B. 干咳无痰
C. 咳痰黄稠
D. 咯痰不爽
E. 咳喘不利

正确答案：A。咳痰带血

解析：本题考查百合固金汤的主治。百合固金汤为补益剂，具有滋养肺肾，止咳化痰之功效。主治肺肾阴亏，虚火上炎证。咳嗽气喘，痰中带血，咽喉燥痛，头晕目眩，午后潮热，舌红少苔，脉细数（A对）。趣记：弟弟卖草药，百元节归母。（生地、熟地、麦冬、甘草、芍药、百合、玄参、桔梗、当归、贝母）。